关于补体的正确叙述是
A. 是一组具有酶促反应活性的脂类物质
B. 主要由活化的淋巴细胞产生
C. 参与免疫病理反应
D. 对热稳定
E. 血清中C1含量最高

正确答案：C。参与免疫病理反应